导致嗜酸性粒细胞增多的药物是
A. 头孢呋辛
B. 甲泼尼龙
C. 泼尼松龙
D. 维生素B₁
E. 坎地沙坦

正确答案：A。头孢呋辛

解析：本题考查嗜酸性粒细胞增多。导致嗜酸性粒细胞增多的药物是头孢呋辛（A对）。应用头孢拉定、头孢氨苄、头孢呋辛钠、头孢哌酮等抗生素可导致嗜酸性粒细胞增多。